动脉血氧分压、氧含量、氧饱和度均降低见于,
A. 乏氧性缺氧
B. 血液性缺氧
C. 循环性缺氧
D. 组织性缺氧
E. 血液性缺氧合并循环性缺氧，

正确答案：A。乏氧性缺氧

解析：动脉血氧分压、氧含量、氧饱和度均降低是低张性缺氧（A对）的血氧变化特点。动脉血氧分压正常、氧含量降低、氧饱和度正常或降低是血液性缺氧（B错）的血氧变化特点。动脉血氧分压、氧含量、氧饱和度均正常是循环性缺氧（C错）和组织性缺氧（D错）的血氧变化的特点。